毛细淋巴管不分布于
A. 脊髓
B. 皮肤
C. 骨骼肌
D. 肝
E. 脾

正确答案：A。脊髓

解析：人体中，除了上皮、角膜、晶状体、软骨、胎盘、脊髓（A对）外均有毛细淋巴管分布。